按《中国药典》的规定，红外光谱仪校正的项目有
A. 波数的准确性和杂散光
B. 波数的准确性和分辨率
C. 检测灵敏度和杂散光
D. 检测灵敏度和分辨率
E. 杂散光和分辨率

正确答案：B。波数的准确性和分辨率